下述慢性盘状红斑狼疮的临床表现不正确的是
A. 角质栓形成
B. 放射状条纹
C. 蝴蝶斑
D. 血管周围有淋巴细胞浸润
E. 固有层密集淋巴细胞浸润带

正确答案：E。固有层密集淋巴细胞浸润带

解析：本题考查慢性盘状红斑狼疮的临床表现。下述慢性盘状红斑狼疮的临床表现不正确的是固有层密集淋巴细胞浸润带（E错，为本题的正确答案）。固有层密集淋巴细胞浸润带常见于扁平苔藓。角质栓形成（A对）；放射状条纹（B对）；蝴蝶斑（C对）；血管周围有淋巴细胞浸润（D对）均为慢性盘状红斑狼疮的临床表现。